维生素D缺乏性佝偻病早期诊断的可靠指标是
A. 血磷
B. 血钙
C. 血钙磷乘积
D. 血碱性磷酸酶
E. 血25-（OH）D₃

正确答案：E。血25-（OH）D₃

解析：维生素D在体内必需经过两次羟化作用后才能发挥生物效应。首先经肝细胞发生第一次羟化，生成25-（OH）D₃，是循环中维生素D的主要形式，故维生素D缺乏性佝偻病早期即出现25-（OH）D₃降低（E对），是最可靠的诊断指标。血钙下降（B错），血磷降低（A错），血钙磷乘积（C错）降低，碱性磷酸酶（D错）正常或稍高为一过性改变，早期经机体代偿后尚可维持正常，不能作为早期可靠的诊断指标。